能醒脑开窍、通络、止痛的藏成药是
A. 五味岩精丸
B. 六味安消散
C. 八味沉香散
D. 十一味金色丸
E. 二十五味珊瑚丸

正确答案：E。二十五味珊瑚丸

解析：本题考查的是二十五味珊瑚丸的功能。能醒脑开窍、通络、止痛的藏成药是二十五味珊瑚丸（E对）。二十五味珊瑚丸的功能与主治：开窍，通络，止痛。用于“白脉病”，神志不清，身体麻木，头昏目眩，脑部疼痛，血压不调，头痛，癫痫及各种神经性疼痛。六味安消散（B错）的功能与主治：和胃健脾，消积导滞，活血止痛。用于脾胃不和，积滞内停所致的胃痛胀满、消化不良、便秘、痛经。八味沉香散（C错）的功能与主治：清心热，养心，安神，开窍。用于热病攻心，神昏谵语；冠心病，心绞痛。十一味金色丸（D错）的功能与主治：清热解毒，化瘀。用于胆囊痞肿，巩膜黄染，消化不良，中毒症。对黄疸性肝病疗效最佳。五味岩精丸（A错）的功能，2022年考试指南未明确说明。